男孩，2岁，右腹股沟包块，卧位可消失，右侧阴囊内未触及睾丸。B超示右侧睾丸位于右腹股沟。正确的治疗方法是
A. 腹股沟疝高位结扎术
B. 睾丸下降固定术
C. 右侧睾丸切除
D. 疝囊高位结扎+睾丸下降固定术
E. 绒毛膜促性腺激素治疗

正确答案：D。疝囊高位结扎+睾丸下降固定术

解析：2岁男性患儿，右腹股沟包块，卧位可消失（提示可能为腹股沟斜疝），右侧阴囊内未触及睾丸，B超示右侧睾丸位于右腹股沟（提示隐睾症），结合患儿临床表现和B超检查，该患儿最可能的诊断为右侧隐睾症并右侧腹股沟疝。因婴幼儿（≤3周岁）的腹肌在发育过程中可逐渐强壮而使腹壁加强，故婴幼儿腹股沟斜疝仅行单纯疝囊高位结扎即可获得较好疗效；对于2岁的隐睾症患儿，应考虑采用睾丸固定术治疗，考虑到该患儿为右侧隐睾症并右侧腹股沟疝，正确的治疗方法应为疝囊高位结扎+睾丸下降固定术（D对AB错）。睾丸切除（C错）多用于睾丸萎缩且不能被拉下并置入阴囊的患儿，而该患儿未提示有睾丸萎缩，故不宜使用。绒毛膜促性腺激素治疗（E错）为1岁以后患儿的短期治疗方案，该患儿已2岁，故不适用。